肝破裂首先考虑的治疗措施是
A. 静脉输注血管收缩药物
B. 补充血容量，同时立即剖腹探查
C. 迅速补充血容量，同时大剂量应用抗生素
D. 静脉输注糖皮质激素
E. 滴注利尿剂改善肾功能

正确答案：B。补充血容量，同时立即剖腹探查

解析：肝破裂西医治疗迅速建立两条以上静脉输液通道，快速静脉输注平衡液，积极配血，尽快输人全血，以纠正休克（B对）。